下列不属于公共卫生监测系统的效益评价指标的是
A. 成本效益
B. 阳性预测值
C. 可接受性
D. 灵活性
E. 共享性

正确答案：D。灵活性

解析：本题考查公共卫生监测系统的效益评价指标。对监测系统的效益评价，包括成本-效益（A对）、成本-效用与成本效果分析、阳性预测值（B对）、可接受性（C对）以及监测系统间的互联与共享功能（E对）等指标。灵活性（D错，为本题正确答案）属于公共卫生监测系统的质量评价指标。